人类小脑后叶中间带区受损时所特有的症状是
A. 肌张力降低
B. 腿反射增强
C. 静止性震颤
D. 意向性震颤
E. 眼震颤

正确答案：D。意向性震颤